镜下观察早期平滑面釉质龋纵断磨片，其病损结构由内向外可分为
A. 透明层、暗层、病损体部、表层
B. 透明层、病损体部、暗层、表层
C. 坏死崩解层、细菌侵入层、脱矿层、透明层
D. 透明层、细菌侵入层、脱矿层、坏死崩解层
E. 透明层、脱矿层、细菌侵入层、坏死崩解层

正确答案：A。透明层、暗层、病损体部、表层

解析：本题考查牙釉质龋。镜下观察早期平滑面釉质龋纵断磨片，其病损结构由内向外可分为透明层、暗层、病损体部、表层（A对）。结合透射光显微镜、偏光显微镜、显微放射摄影观察早期平滑面釉质龋纵断磨片，由深层至表层病变可分为四层，即透明层、暗层、病损体部、表层。